小儿会爬是在
A. 四个月
B. 六个月
C. 七个月
D. 八个月
E. 九个月

正确答案：D。八个月

解析：本题考查小儿神经精神发育进程。小儿会爬是在八个月（D对）。4个月（A错）：扶着髋部时能坐；可在俯卧位时用两手支持抬起胸部；手能握待玩具。6个月（B错）：能独坐一会；用手摇玩具。7个月（C错）：会翻身，自己独坐很久；将玩具从一手换入另一手。8个月：会爬；会自己坐起来、躺下去；会扶着栏杆站起来；会拍手。9个月（E错）：试独站；会从抽屉中取出玩具。